属于Ⅱ型超敏反应疾病的是
A. 青霉素过敏
B. 血清病
C. 新生儿溶血
D. 结核菌素试验
E. 类风湿关节炎

正确答案：C。新生儿溶血

解析：Ⅱ型超敏反应又称为细胞型或细胞毒型超敏反应，是由IgG或IgM抗体与靶细胞表面相应抗原结合后，在补体、吞噬细胞和NK细胞参与下，引起的以细胞溶解或组织损伤为主的病理免疫反应。与Ⅱ型超敏反应有关的疾病有输血反应、新生儿溶血病（C对）、药物过敏性血细胞减少症等。青霉素过敏（A错）（P148）属于Ⅰ型超敏反应。血清病（B错）（P152）和类风湿关节炎（E错）（P152）属于Ⅲ型超敏反应。结核菌素试验（D错）（P154）属于Ⅳ型超敏反应。